恶性贫血患者和全胃切除患者（血清中检出内因子抗体）需要终生使用的药物是
A. 叶酸
B. 维生素B₁
C. 维生素B₁₂
D. 维生素B₆
E. 维生素C

正确答案：C。维生素B₁₂

解析：本题考查巨幼细胞贫血的药物治疗方案和合理使用。恶性贫血患者和全胃切除者（血清中检出内因子抗体）需要终生维持治疗，肌注维生素B₁₂（C对）100㎍，1次/1月。